下列属于预防内源性生殖道感染的措施的是
A. 推迟首次性行为的时间
B. 每天应使用清水或浴液、香皂或肥皂清洗外阴
C. 一旦出现性传播感染症候及早到正规医院就医，并与性伴同治
D. 坚持正确使用安全套
E. 尽早识别和治疗生殖道感染

正确答案：B。每天应使用清水或浴液、香皂或肥皂清洗外阴

解析：本题考查预防内源性生殖道感染的措施。内源性感染预防措施：（1）避免使用清洁剂、消毒剂、中药等冲洗阴道，阴道冲洗应由医务人员根据病情酌情使用。（2）每天应使用清水或浴液、香皂或肥皂清洗外阴（B对ACDE错）。（3）必须在医生指导下使用抗生素，尽量避免长期服用。